女，26岁。平素月经规则，停经48天，阴道少量流血5天，偶有腹痛，检査宫颈口关闭，子宫大小与孕周相符。患者可能的诊断是
A. 难免流产
B. 先兆流产
C. 不全流产
D. 完全流产
E. 习惯性流产

正确答案：B。先兆流产

解析：育龄期女性，停经48天（流产为妊娠＜28周、胎儿体重＜1000g而终止者），出现少量阴道流血，偶有下腹痛（流产临床表现主要为停经后阴道流血和腹痛，先兆流产阴道流血量少，阵发性腹痛不剧烈），宫颈口关闭，子宫大小与孕周相符（先兆流产妇科检查宫颈口未开，胎膜未破，子宫大小与孕周相符），患者可能的诊断是先兆流产（B对）。难免流产（P48）（A错）是指流产不可避免，在先兆流产的基础上，阴道流血量增多，阵发性下腹痛加剧，宫口已扩张。不全流产（P48）（C错）是指难免流产继续发展，宫颈口扩张，部分妊娠物排出宫腔，还有部分残留于宫腔内或嵌顿于宫颈口处，或胎儿排出后胎盘滞留宫腔或嵌顿于宫颈口，影响子宫收缩，导致大量出血，甚至发生休克，子宫小于停经周数。完全流产（P49）（D错）是指妊娠物已完全排除，阴道流血逐渐终止，腹痛逐渐消失，子宫口已关闭，子宫接近正常大小。习惯性流产（P49）（E错）即复发性流产，是指同一性伴侣连续发生3次及3次以上的自然流产。